何者错误
A. 位于颅后窝
B. 位于脑干的背面
C. 小脑中间的缩细部称小脑蚓
D. 小脑两侧膨大部称小脑半球
E. 小脑扁桃体是小脑半球内的灰质团块

正确答案：E。小脑扁桃体是小脑半球内的灰质团块

解析：小脑位于颅后窝（A对），借小脑脚连于脑干的背面（B对）。从外形上看，小脑两侧膨大部称小脑半球（D对），小脑中间的缩细部称小脑蚓（C对），在小脑半球下面的前内侧，各有一突出部，称小脑扁桃体（E错，为本题正确答案），因而小脑扁桃体不是小脑半球内的结构。